维生素D缺乏性佝偻病的剂量应是
A. 依病情程度的不同而剂量不同
B. 不同分期，使用剂量相同
C. 剂量越大效果越好
D. 先用小剂量逐渐加大剂量
E. 剂量越小越安全效果越好

正确答案：A。依病情程度的不同而剂量不同

解析：治疗的目的为控制活动期，防止骨骼畸形。依病情程度的不同而剂量不同。掌握“维生素D缺乏性佝偻病”知识点。